右美沙芬可用于
A. 镇咳
B. 平喘
C. 祛痰
D. 止吐
E. 助消化

正确答案：A。镇咳

解析：本题考查右美沙芬。右美沙芬可用于镇咳（A对）。右美沙芬是合成的吗啡类衍生物，为非依赖性中枢性镇咳药。用于各种原因引起的干咳，包括上呼吸道感染（如感冒和咽炎）、支气管炎等呼吸系统疾病用药引起的咳嗽。平喘药（B错）主要有沙丁胺醇、克伦特罗、茶碱等。祛痰药（C错）主要有氯化铵、氨溴索等。促胃肠动力（止吐）（D错）药主要有多潘立酮、莫沙必利等。助消化（E错）的药物主要有胃蛋白酶、稀盐酸等。